体内体液中各部分间渗透压关系是
A. 细胞内高于细胞外
B. 细胞内低于细胞外
C. 血浆低于组织间液
D. 组织间液低于细胞内液
E. 细胞内外液基本相等

正确答案：E。细胞内外液基本相等

解析：各部分体液中所含阴、阳离子数的总和是相等的，并保持电中性，如果以总渗透压计算，细胞内外液也是基本相等的（E对ABD错）。机体通过细胞内外液渗透压的相对稳定是维持细胞形态功能的条件。细胞外液的组织间液和血浆的电解质在构成和数量上大致相等，故血浆与组织间液渗透压也大致相等（C错）。